患者，女，43岁，1周前右上第一前磨牙开始咀嚼痛，伴有右侧眶下区肿痛3天。检查见右眶下肿胀明显、右上第一前磨牙深龋，髓腔暴露，叩诊（+++），前庭沟肿胀，压痛，有波动感。如行切开引流，切开应选择
A. 眶下皮肤垂直切口
B. 眶下皮肤横行切口
C. 前庭沟波动最明显处纵向切口
D. 前庭沟波动最明显处横向切口
E. 拔除患牙，牙槽窝引流

正确答案：D。前庭沟波动最明显处横向切口

解析：本题考查间隙感染概述、眶下间隙、咬肌间隙感染。眶下间隙蜂窝组织炎阶段可从局部外敷中药及针对感染病灶牙的处理着手；一旦脓肿形成应及时作切开引流术。按低位引流原则常在口内上颌前牙及前磨牙区口腔前庭黏膜转折处做切口，横行切开黏骨膜达骨面（D对），用血管钳向尖牙窝方向分离脓肿，使脓液充分引流，生理盐水冲洗脓腔，留置橡皮引流条。